尿血与血淋的鉴别要点是
A. 有无发热
B. 有无尿痛
C. 有无腹痛
D. 有无排尿困难
E. 出血量的多少

正确答案：B。有无尿痛

解析：淋证血淋常与尿血相鉴别。两者均为血随尿出，甚至溺出纯血的症状，但尿血多无疼痛之感，或有轻微的胀痛或热痛，但终不若血淋的小便淋漓而疼痛难忍，发热、腹痛、排尿困难、出血量的多少不作为鉴别两者的主要症状（B对ACDE错）。